患者，女，35岁，颈上部有一肿物3年，无明显增长，近几日发生上呼吸道感染，肿物骤然增大，感觉不适。检查见肿物位于胸锁乳突肌上1/3前缘附近，质软，有波动感，无搏动，体位试验阴性，该患者最可能的诊断是
A. 海绵状血管瘤
B. 神经鞘瘤
C. 囊性水瘤
D. 鳃裂囊肿
E. 甲状舌管囊肿

正确答案：D。鳃裂囊肿

解析：第二鳃裂囊肿常位于颈上部，大多在舌骨水平，胸锁乳突肌上1/3前缘附近。有时附着于颈动脉鞘的后部，或自颈内、外动脉分叉之间突向咽侧壁。囊肿表面光滑，但有时呈分叶状。肿块大小不定，生长缓慢，患者无自觉症状，如发生上呼吸道感染后可以骤然增大，则感觉不适。若有继发感染，可伴发疼痛，并放射至腮腺区。触诊时肿块质地软，有波动感，但无搏动，此可与颈动脉体瘤相区别。掌握“甲状舌管囊肿及鳃裂囊肿”知识点。